患者，男，55岁，诊断为痛风合并泌尿系统结石。首选的降尿酸药物是
A. 苯溴马隆
B. 吲哚美辛
C. 氢氯噻嗪
D. 非布司他
E. 秋水仙碱

正确答案：D。非布司他

解析：本题考查抗痛风药物。非布司他（D对）和别嘌醇为抑制尿酸生成药。